人类的行为有本能行为和
A. 生物行为
B. 社会行为
C. 自发行为
D. 自主行为
E. 主动行为

正确答案：B。社会行为